以下哪项不是鉴别牙龈增生性疾病的主要依据
A. 骨髓象
B. 全身病史
C. X线片
D. 主诉及临床表现
E. 服药史

正确答案：C。X线片

解析：本题考查鉴别牙龈增生性疾病的主要依据。X线片（C错，为本题的正确答案）不是鉴别牙龈增生性疾病的主要依据。X线片的原理是利用X线的穿透作用，在穿透人体的不同组织时，形成不同的影像。因为软组织对X线的吸收作用，不能用于软组织的检查，而牙龈增生性疾病的主要症状是牙龈的增生，故X线片不能作为鉴别牙龈增生性疾病的主要依据。骨髓象（A对）是用于反应骨髓造血活跃程度的，当发生白血病，骨髓增生“明显活跃”或“极度活跃”，故可用骨髓象诊断白血病引起的牙龈增生。广泛牙龈增生的临床表现可作为主诉（D对）用以鉴别牙龈增生性疾病。药物性牙龈肥大是患者因某些全身性疾病长期服用某些药物而引起牙龈的纤维性增生和体积增大，鉴别该病时需要根据临床表现、长期服药史（E对）以及全身病史（B对）来诊断。